根据《抗菌药物临床应用管理办法》，基层医疗卫生机构抗菌药物供应目录应
A. 在省级药品监督管理部门备案
B. 由省级药品监督管理部门审批
C. 由医疗机构药学部门制定
D. 选用基本药物目录中的抗菌药物品种
E. 根据临床需要，随时增加总品种数

正确答案：D。选用基本药物目录中的抗菌药物品种

解析：本题考查的是抗菌药物分级管理目录及采购。根据《抗菌药物临床应用管理办法》，基层医疗卫生机构抗菌药物供应目录应选用基本药物目录中的抗菌药物品种（D对）。抗菌药物分级管理目录及采购：医疗机构应当按照省级卫生行政部门制定的抗菌药物分级管理目录，制定本医疗机构抗菌药物供应目录，并向核发其《医疗机构执业许可证》的卫生行政部门备案（AB错）。医疗机构抗菌药物供应目录包括采购抗菌药物的品种、品规。未经备案的抗菌药物品种、品规，医疗机构不得采购。医疗机构应当严格控制本医疗机构抗菌药物供应目录的品种数量。同一通用名称抗菌药物品种，注射剂型和口服剂型各不得超过2种。具有相似或者相同药理学特征的抗菌药物不得重复列入供应目录。其中碳青霉烯类抗菌药物注射剂型严格控制在3个品规内。要按照规定调整抗菌药物供应目录，调整周期原则上为2年，最短不少于1年，并在目录调整后15日内报核发其《医疗机构许可证》的卫生计生行政部门备案。医疗机构应当按照国家药品监督管理部门批准并公布的药品通用名称购进抗菌药物，优先选用《国家基本药物目录》《国家处方集》和《国家基本医疗保险、工伤保险和生育保险药品目录》收录的抗菌药物品种。基层医疗卫生机构只能选用基本药物中的抗菌药物品种。因特殊治疗需要，医疗机构需使用本医疗机构抗菌药物供应目录以外抗菌药物的，可以启动临时采购程序。临时采购应当由临床科室提出申请，说明申请购入抗菌药物名称、剂型、规格、数量、使用对象和使用理由，经本医疗机构抗菌药物管理工作组审核同意后，由药学部门临时一次性购入使用。医疗机构应当严格控制临时采购抗菌药物的品种和数量，同一通用名抗菌药物品种启动临时采购程序原则上每年不得超过5例次。如果超过5例次，应当讨论是否列入本医疗机构抗菌药物供应目录。调整后的抗菌药物供应目录总品种数不得增加（E错）。